患者，男，55岁。慢性冠状动脉供血不足其心电图诊断之一为“Ⅰ度房室传导阻滞房室传导延缓”其心电图的表现应为
A. P波增宽
B. P-R间期延长
C. QRS波群时限延长
D. ST段延长
E. Q-T间期延长

正确答案：B。P-R间期延长

解析：一度房室传导阻滞的典型心电图特点：（1）每一个窦性P波均能下传心室并产生QRS-T波群。（2）P-R间期>0.20s（成人）；小儿（14岁以下）P-R间期≥0.18s。（3）P-R间期大于正常最高值（视心率而定）（B对）。P波增宽，有可能是左心房的肥大，左心房肥大，其原因常见于二尖瓣的狭窄，所以又被称为二尖瓣型的P波（A错）。QRS时限代表心室激动持续的时间。QRS波时限增宽常见的原因有：完全性左束支阻滞，完全性右束支阻滞，预激综合征，室性心动过速等（C错）。ST段延长常见于下列疾病（1）低钙血症：ST段平坦延长，Q-T间期延长，多见于慢性肾功能不全、甲状旁腺功能减退、重症胰腺炎、维生素D代谢障碍等。（2）长Q-T间期综合征：原发性或继发性的长Q-T间期综合征均可见ST段延长导致Q-T间期延长（D错）。Q-T间期有随年龄增长而短缩的趋向，昏厥发作时心电图呈室性心动过速，多数为尖端扭转型，也可有心室颤动或心室停搏。发作前后可有T波电压交替，频发室性过早搏动（E错）。